患者，男，55岁。胸痛如窒，痛引肩背，气短喘促，四肢沉重，形体肥胖，舌苔浊腻，脉滑。其证候是
A. 心血瘀阻
B. 阴寒凝滞
C. 痰浊壅塞
D. 阳气虚衰
E. 气阴两虚

正确答案：C。痰浊壅塞

解析：题中患者以胸痛如窒为主症，故诊断为胸痹。痰浊盘踞，胸阳失展，故胸痛如窒；阻滞脉络，故痛引肩背；气机痹阻不畅，故见气短喘促；脾主四肢，痰浊困脾，脾气不运，故四肢沉重；形体肥胖，舌苔浊腻，脉滑均为痰浊壅阻之征。故诊断为胸痹痰浊壅塞证（C对）。心血瘀阻证可见心胸疼痛，如刺如绞，痛有定处，入夜为甚，无肢体沉重，形体肥胖，痰多等症（A错）。阴寒凝滞证可见胸痛彻背，感寒痛甚，面色苍白，四肢厥冷等症，无肢体沉重，形体肥胖，痰多等症（B错）。阳气虚衰可见胸闷气短，甚则胸痛彻背，心悸，汗出，畏寒肢冷等症，无肢体沉重，形体肥胖，痰多等症（D错）。气阴两虚可见心胸隐痛，时作时休，心悸气短，动则益甚，伴倦怠乏力等症，无肢体沉重，形体肥胖，痰多等症（E错）。